抗心律失常谱广而t1/2长的药物是
A. 奎尼丁
B. 普萘洛尔
C. 胺碘酮
D. 普罗帕酮
E. 普鲁卡因胺

正确答案：C。胺碘酮